水肿细胞电镜下观察，主要细胞器的病变是
A. 肿胀的线粒体和扩张的内质网
B. 发育不良的桥粒
C. 肿胀的溶酶体
D. 肿胀的核糖体
E. 扩张的高尔基器

正确答案：A。肿胀的线粒体和扩张的内质网

解析：水肿细胞电镜下观察，主要细胞器的病变是线粒体肿胀和内质网扩张（A对）。桥粒是一种常见的细胞连接结构，其作用是维持细胞间的连接，桥粒发育不良（B错）会使角质形成细胞出现松解而引起表皮内疱（如天疱疹等）。溶酶体（C错）、核糖体（D错）和高尔基体（E错）均为细胞内具有重要生理功能的细胞器，细胞水肿时可见这三种细胞器肿胀或扩张，但不是最主要的病变。